以下关于住宅地段的卫生要求的叙述，哪一项是错误的
A. 土壤清洁、干燥、渗水性好
B. 与污染源之间应有卫生间隔地带
C. 有良好的日照，通风良好
D. 地下水位高
E. 地势平坦而有一定坡度，有利排水

正确答案：D。地下水位高

解析：本题考查住宅地段的卫生要求。住宅地段的卫生要求有：土壤清洁、干燥、渗水性好（A对）；与污染源之间应有卫生间隔地带（B对）；有良好的日照，通风良好（C对）；地势平坦而有一定坡度，有利排水（E对）。地下水位高（D错，为本题正确答案）会导致地表水渗入地下，从而影响地下水的质量，使地下水变得污染，从而影响到住宅地段的卫生。